完全随机设计5组均数比较方差分析的备择假设（H₁）是：5个总体均数
A. 相同
B. 至少有2个相同
C. 至少有3个相同
D. 5个总体均数不同或不全相同
E. 5个总体均数各不相同

正确答案：D。5个总体均数不同或不全相同